中毒后临床表现为双侧瞳孔散大的毒物是
A. 吗啡
B. 氯丙嗪
C. 阿托品
D. 阿片类药物
E. 有机磷农药

正确答案：C。阿托品

解析：中毒后临床表现为双侧瞳孔散大的毒物是阿托品（C对），其是胆碱受体阻断剂，中毒时还可以导致神志模糊、烦躁不安、抽搐、昏迷和尿潴留等症状。吗啡（A错）过量可引起急性中毒，主要表现为昏迷、深度呼吸抑制以及瞳孔极度缩小(针尖样瞳孔），常伴有血压下降、严重缺氧以及尿潴留，呼吸麻痹是致死的主要原因。氯丙嗪（B错）过量可引起口干、视物不清、上腹部不适、乏力、体位性低血压、锥体外系反应等。阿片类药物（D错）过量可引起胃肠道反应（恶心、呕吐）、便秘、中枢神经系统抑制、排尿困难等症状。有机磷农药（E错）中毒可引起瞳孔缩小、腹痛、腹泻、大小便失禁、大汗、流涎、呼吸困难等症状。